不是慢性缺氧时组织细胞的代偿性反应的是
A. 线粒体内呼吸功能增强
B. 糖酵解增强
C. 肌红蛋白增加
D. 红细胞计数增加
E. 以上都不是

正确答案：D。红细胞计数增加

解析：慢性缺氧时组织、细胞可出现一系列功能、代谢和结构的改变。其中有的起代偿作用，如线粒体内呼吸功能增强（A对），使细胞利用氧的能力增强；糖酵解增强（B对）；载脂蛋白表达增强（如肌红蛋白）（C对）。红细胞计数增加（D错，为本题正确答案）是缺氧时血液系统的变化，是由于骨髓造血功能增强所致。